运动员禁用的药品是
A. 右美沙芬
B. 甲睾酮
C. 非洛地平
D. 非诺贝特
E. 布洛芬

正确答案：B。甲睾酮

解析：本题考查运动员禁用的药品。甲睾酮（B对）属于蛋白同化激素类兴奋剂，为运动员禁用的药品。右美沙芬（A错）属于中枢性镇咳药。非洛地平（C错）属于钙通道阻滞剂。非诺贝特（D错）属于贝特类调节血脂药。布洛芬（E错）属于解热镇痛药。